宗气的生理功能是
A. 化生血液
B. 促进生长发育
C. 推动气血的运行
D. 维持体温的相对恒定
E. 温养脏腑、肌肉、皮毛

正确答案：C。推动气血的运行

解析：本题考查的是宗气的生理功能。宗气的生理功能是推动气血的运行（C对）。人体之气，由于生成来源、分布部位及功能特点的不同，而有着各自不同的名称。1.元气：又称“原气”，是人体最基本、最重要的气，是人体生命活动的原动力。元气的生理功能：推动和促进人体的生长发育（B错），温煦和激发各脏腑、经络等组织器官的生理活动。元气是人体生命活动的原动力，是维持人体生命活动的最基本的物质。机体元气充沛，则各脏腑、经络等组织器官的活力旺盛，体质强健而少病。若因先天禀赋不足，或因后天水谷失养，或因久病损耗，以致元气的生成不足或耗伤太过时，就会形成元气虚衰而产生种种病变。2.宗气：是积于胸中之气。宗气在胸中集聚之处，称作“气海”，又称“膻中”。宗气的生理功能：上走息道以行呼吸，贯注心脉以行气血。故凡语言、声音、呼吸的强弱，气血的运行，肢体的寒温和活动能力，视听功能，心搏的强弱及其节律等，皆与宗气盛衰有关。临床上亦常以心尖搏动部位（虚里）的搏动状况和脉象来了解宗气的盛衰。3.营气：又称“荣气”，与卫气相对而言，营气行于脉内而属阴，故又有“营阴”之称。营气的生理功能：有营养人体和化生血液（A错）两方面。营气运行于全身血脉之中，成为血液的重要组成部分。故营气与血液的关系极为密切，可分而不可离，故常以“营血”并称。4.卫气：与营气相对而言，卫气行于脉外而属阳，又称“卫阳”。卫气的生理功能有三个方面：一是护卫肌表，防御外邪入侵；二是温养脏腑、肌肉、皮毛（E错）等；三是调节控制汗孔的开合和汗液的排泄，以维持体温的相对恒定（D错）。所以，人体卫外功能的强弱，以及能否维持体温的相对恒定，同卫气的功能活动是否正常有着密切关系。